与圆环形卡环比较，杆形卡环
A. 弹性好，与基牙接触面积小，推型固位作用弱，对基牙损伤小，稳定作用好于圆环形卡环
B. 弹性好，与基牙接触面积小，推型固位作用强，对基牙损伤小，稳定作用好于圆环形卡环
C. 弹性好，与基牙接触面积小，推垂固位作用弱，对基牙损伤小，稳定作用不如圆环形卡环
D. 弹性好，与基牙接触面积小，推型固位作用强，对基牙损伤大，稳定作用不如圆环形卡环
E. 弹性好，与基牙接触面积小，推型固位作用强，对基牙损伤小，稳定作用不如圆环形卡环

正确答案：E。弹性好，与基牙接触面积小，推型固位作用强，对基牙损伤小，稳定作用不如圆环形卡环

解析：本题考查杆形卡环的优缺点。圆环形卡环只有固位臂尖有弹性；杆形卡环弹性好，卡臂尖约2mm进入基牙倒凹区，与基牙接触，所以接触面积小，卡环是从义齿基托或固位网发出，向上向内越过龈组织到达基牙唇颊面突点以下的有利倒凹内，固位作用是由下向上呈推型固位；当受到功能性咬合力时，杆卡会向龈方移动，与基牙脱离接触，起到应力中断的作用，减少对基牙的扭力，对基牙损伤小；但是只有近中（牙合）支托、远中邻面板和小连接体起到舌侧对抗的作用，稳定作用不如圆环形卡环的对抗臂（E对）。